患者女性，45岁，既往月经正常，近1年来经期延长10～15天，量多，此次停经50天，后有阴道出血20天，血红蛋白80g/L，盆腔检查（-），基础体温单相。首选的治疗是
A. 雌-孕激素联合周期治疗
B. 促排卵药以调整周期
C. 月经周期后半期应用孕激素
D. 雌激素周期疗法，以调整周期
E. 雌-孕激素序贯疗法

正确答案：C。月经周期后半期应用孕激素

解析：孕激素，止血的机制是雌激素作用下持续增生的子宫内膜转化为分泌期，并有对抗雌激素作用，使内膜不再增厚，停药后子宫内膜脱落较完全，可起到药物性刮宫作用，从而达到止血目的。适用于血红蛋白大于70g/L功血者。此题中患者血红蛋白80g/L，所以选C。掌握“功能失调性子宫出血”知识点。